关于肠系膜根的说法正确的是
A. 斜向左下跨过脊柱及其前方的结构
B. 起于第12胸椎体的右侧
C. 为空、回肠、结肠系膜附着于腹后壁的部分
D. 止于右骶髂关节的前方
E. 无

正确答案：D。止于右骶髂关节的前方

解析：肠系膜为空、回肠附着于腹后壁的部分（C错）称为肠系膜根,起自第2腰椎左侧（B错）,斜向右下跨过脊柱及其前方结构（A错）,止于右骶骼关节前方（D对）。